对革兰阴性菌和革兰阳性菌有强烈的杀菌作用，对耐药肠杆菌某些菌株敏感的第四代头孢菌素类是
A. 头孢拉定
B. 头孢克洛
C. 头孢吡肟
D. 头孢噻肟
E. 头孢唑林

正确答案：C。头孢吡肟

解析：本题考查头孢吡肟。头孢吡肟（C对）为第四代头孢菌素，对革兰阴性菌和革兰阳性菌有强烈的杀菌作用，对耐药肠杆菌某些菌株敏感。头孢拉定（A错）和头孢唑林（E错）为第一代头孢菌素。头孢克洛（B错）为第二代头孢菌素。头孢噻肟（D错）为第三代头孢菌素。